患者，男，55岁，诊断为慢性肾脏病G4期。入院后查BP160/80mmHg，血钾5.6mmol/L，血肌酐320μ㏖/L。不宜选用的降压药物是
A. 贝那普利
B. 美托洛尔
C. 硝苯地平
D. 氨氯地平
E. 多沙唑嗪

正确答案：A。贝那普利

解析：本题考查ACEI的禁忌证和慎用情况。ACEI禁用于既往有血管神经性水肿（导致喉头水肿）病史患者、妊娠期妇女、高钾血症、双侧肾动脉狭窄患者。该患者血钾偏高，不宜使用ACEI类（普利类）（A对）药物。